从批准文号格式判断，属于国产特殊用途化妆品的是
A. 国妆备进字J××××××××
B. 国妆特字G××××××××
C. 国妆进特字（年份）第××××号
D. 国妆特字（年份）第××××号

正确答案：B。国妆特字G××××××××

解析：本题考查化妆品批准文号管理。从批准文号格式判断，属于国产特殊用途化妆品的是国妆特字G××××××××（B对）。现行化妆品批准文号存在卫生行政部门和化妆品监督管理部门分别颁发的两种形式。国产特殊用途化妆品批准文号体例为“国妆特字G××××××××”或“卫妆特字（年份）第××××号”，国产非特殊用途化妆品由省级化妆品监督管理部门实施备案管理。进口特殊用途化妆品批准文号体例为“国妆特进字J××××××××”或“卫妆特进字（年份）第××××号”（CD错），进口非特殊用途化妆品备案号体例为“国妆备进字J××××××××（A错）”或“卫妆备进字（年份）第××××号”。